根据《药品经营质量管理规范》，下列药品批发企业出库管理的叙述，错误的是
A. 药品出库应遵循“先产先出”、“近期先出”和按批号发货的原则
B. 药品出库应进行复核和质量检查
C. 一类精神药品和二类精神药品应建立双人核对制度
D. 药品出库应做好药品质量跟踪记录，以保证能快速、准确地进行质量跟踪
E. 质量跟踪记录应保存至超过药品有效期一年，但不得少于三年

正确答案：C。一类精神药品和二类精神药品应建立双人核对制度